连续使用易产生依赖性的药品是
A. 麻醉药品
B. 第二类精神药品
C. 两者均是
D. 两者均不是

正确答案：C。两者均是

解析：本题考查易产生依赖性的药品。连续使用易产生依赖性的药品是麻醉药品和精神药品（C对）。麻醉药品是指连续使用后易产生身体依赖性、能成瘾癖的药品。精神药品是指直接作用于中枢神经系统，使之兴奋或抑制，连续使用可产生依赖性的药品。